戒断综合征是
A. 机体连续多次用药后，其反应性降低，需加大剂量才能维持原有疗效的现象
B. 反复使用具有依赖性特征的药物，产生一种适应状态，中断用药后产生的一系列强烈的症状或损害
C. 病原微生物对抗菌药的敏感性降低甚至消失的现象
D. 连续用药后，可使机体对药物产生生理/心理的需求
E. 长期使用拮抗药造成受体数量或敏感性提高的现象

正确答案：B。反复使用具有依赖性特征的药物，产生一种适应状态，中断用药后产生的一系列强烈的症状或损害

解析：本题考查戒断综合征。戒断综合征是反复使用具有依赖性特征的药物，产生一种适应状态，中断用药后产生的一系列强烈的症状或损害（B对）。戒断综合征是指中枢神经系统对长期使用的药物所产生的一种身体适应状态；一旦停药，将发生一系列生理功能紊乱。机体连续多次用药后，其反应性降低，需加大剂量才能维持原有疗效的现象（A错）是耐受性。病原微生物对抗菌药的敏感性降低甚至消失的现象（C错）是耐药性。连续用药后，可使机体对药物产生生理/心理的需求（D错）是药物依赖性。长期使用拮抗药造成受体数量或敏感性提高的现象（E错）是受体的向上调节。